氰化物中毒的解毒剂有
A. 亚硝酸钠
B. 亚甲蓝
C. 硫代硫酸钠
D. 纳洛酮
E. 二巯丙醇

正确答案：A、B、C。亚硝酸钠；亚甲蓝；硫代硫酸钠

解析：本题考查氰化物中毒解救。氰化物中毒的解毒剂有亚硝酸钠（A对）、亚甲蓝（B对）、硫代硫酸钠（C对）。亚甲蓝（美蓝）用于氰化物中毒，小剂量可治疗高铁血红蛋白血症（亚硝酸盐中毒等）。硫代硫酸钠（次亚硫酸钠）主要用于氰化物中毒，也用于砷、汞、铅中毒等。亚硝酸钠治疗氰化物中毒。纳洛酮（D错）适用于急性阿片类中毒（表现为中枢和呼吸抑制）及急性乙醇中毒的解救。二巯丙醇（E错）用于砷、汞、金、铋剂酒石酸锑钾中毒。